胰岛素对血糖代谢调节错误的是
A. 促进细胞摄取葡萄糖
B. 胰岛素使进食后吸收的葡萄糖大量转化成糖原
C. 促进葡萄糖转变成脂肪酸
D. 抑制糖原异生
E. 抑制葡萄糖氧化生成高能磷酸化合物

正确答案：E。抑制葡萄糖氧化生成高能磷酸化合物